测量细菌常用的单位是
A. mm
B. μm
C. nm
D. pm
E. cm

正确答案：B。μm

解析：测量细菌常用的单位是微米（μm），1μm=10-3mm即1/1000mm。掌握“细菌的大小、形态和基本结构”知识点。